醛固酮增高性水肿病人宜选用的药物是
A. 呋塞米
B. 氨苯蝶啶
C. 螺内酯
D. 氢氯噻嗪
E. 甘露醇

正确答案：C。螺内酯

解析：螺内酯利尿作用弱，缓慢而持久，其利尿作用与体内醛固酮水平有关，醛固酮增高的水肿患者效果较好（C对）。呋塞米临床应用：严重水肿，急性脑水肿及肺水肿，及慢性肾衰竭，排除毒物。（A错）氨苯蝶啶临床应用：与其他利尿药合用于顽固性水肿（B错）。氢氯噻嗪临床应用：各型轻、中度水肿，高血压，轻度尿崩症（D错）。甘露醇临床应用：脑水肿、青光眼、急性肾衰竭（E错）。